环境影响评价的英文简称是
A. EIA
B. EEA
C. EEE
D. EIE
E. CIE

正确答案：A。EIA

解析：本题考查环境影响评价的英文简称。环境影响评价的英文简称是EIA（A对BCDE错）。环境影响评价是指对规划和建设项目实施后可能造成的环境影响进行分析、预测和评估，提出预防或者减轻不良环境影响的对策和措施，并进行跟踪监测的方法与制度。